有效成分不溶于水，内服宜入丸散的药是
A. 芒硝
B. 大黄
C. 甘遂
D. 芫花
E. 红大戟

正确答案：C。甘遂

解析：本题考查的是甘遂的用量用法。有效成分不溶于水，内服宜入丸散的药是甘遂（C对）。甘遂：【用法用量】内服：宜入丸散，每次0.5～1.5g。其泻下有效成分不溶于水，醋制可减低毒性。外用：生品适量，捣敷。芒硝（A错）：【用法用量】内服：汤剂，10～15g，冲入药汁内或开水溶化；或入丸散。外用：适量，喷撒，漱口，点眼，化水坐浴。大黄（B错）：【用法用量】内服：煎汤，一般用5～10g，热结重症用15～20g，散剂减半。外用：适量，研末敷。生大黄泻下作用强，欲攻下者宜生用，入汤剂应后下，久煎则泻下力减弱；亦可用开水泡服，或研末吞服。酒大黄，取酒上行之性，多用于上部火热之证。制大黄，泻下力减弱，活血作用较好，多用于瘀血证或不宜峻下者。大黄炭则凉血化瘀止血。芫花（D错）：【用法用量】内服：汤剂，1.5～3g；散剂，每次0.5～1g。醋制能减低毒性。外用：适量，研末调敷。红大戟（E错）：【用法用量】内服：煎汤，1.5～3g；研末，0.3～1g，或入丸散。外用：适量，捣敷，或煎汤洗。